女，20岁。腹泻、呕吐伴轻度腹痛1天，6月下旬来诊。共腹泻6次，开始为黄稀便，继之水样便。呕吐1次，为胃内容物。无发热。粪便检查动力试验（+），碱性蛋白胨水培养有细菌生长。最可能的诊断为
A. 细菌性痢疾
B. 沙门菌食物中毒
C. 霍乱
D. 空肠弯曲菌肠炎
E. 变形杆菌肠炎

正确答案：C。霍乱

解析：患者腹泻、呕吐，频次较多，为水样便（霍乱泻吐期表现），且动力试验和碱性蛋白胨水培养阳性（霍乱病原菌检查），最可能的诊断为霍乱（C对）。细菌性痢疾（A错）有黏液脓血便，左下腹压痛。沙门菌食物中毒（B错）有明显进食后腹泻症状。空肠弯曲菌肠炎（D错）空肠弯曲菌肠炎是由空肠弯曲菌引起的急性肠道传染病，临床以发热、腹痛、血性便，粪便中有较多中性白细胞和红细胞为特征。变形杆菌肠炎（E错）主要表现为恶心、呕吐、腹痛、腹泻、头晕、头痛及发热等，大便每日数次至十余次，多为水样便，有恶臭，少数带粘液，无脓血。